需要医疗机构开展调查的抗菌药物临床应用异常情况是
A. 使用量异常增长的抗菌药物
B. 半年内使用量始终居于前列的抗菌药物
C. 经常超适应证、超剂量使用的抗菌药物
D. 频繁发生严重不良事件的抗菌药物
E. 以上说法均正确

正确答案：E。以上说法均正确

解析：抗菌药物临床应用异常情况的调查和处理医疗机构应当对以下抗菌药物临床应用异常情况开展调查，并根据不同情况作出处理：①使用量异常增长的抗菌药物；②半年内使用量始终居于前列的抗菌药物；③经常超适应证、超剂量使用的抗菌药物；④企业违规销售的抗菌药物；⑤频繁发生严重不良事件的抗菌药物。掌握“抗菌药物临床应用概述及管理”知识点。